关于轻度慢性龈缘炎病损描述哪项是错误的
A. 累及游离龈
B. 累及龈乳头
C. 累及附着龈
D. 牙龈色泽改变
E. 点彩可消失

正确答案：C。累及附着龈

解析：本题考查慢性龈炎的临床表现。关于轻度慢性龈缘炎病损错误的是累及附着龈（C错，为本题正确答案）。慢性龈缘炎又称慢性龈炎是菌斑性牙龈病中最常见的疾病。轻度慢性龈缘炎的炎症较轻，病损部位局限于游离龈（A对）和龈乳头（B对）。牙龈变为鲜红或暗红色，炎性充血可波及附着龈。患慢性龈炎附着龈处组织水肿，点彩可消失（E对），表面光滑发亮。正常牙龈呈粉红色，患轻度慢性龈炎时，牙龈色泽改变（D对），游离龈和龈乳头变为鲜红或暗红色。